下列中药中药用部位是干燥成熟果实的是
A. 地肤子
B. 山茱萸
C. 马钱子
D. 肉豆蔻
E. 枳实

正确答案：A。地肤子

解析：本题考查的是地肤子的来源。下列中药中药用部位是干燥成熟果实的是地肤子（A对）。地肤子：【来源】为藜科植物地肤的干燥成熟果实。山茱萸（B错）：【来源】为山茱萸科植物山茱萸的干燥成熟果肉。马钱子（C错）：【来源】为马钱科植物马钱的干燥成熟种子。肉豆蔻（D错）：【来源】为肉豆蔻科植物肉豆蔻的干燥种仁。枳实（E错）的药用部位是幼果。